竞争性结合醛固酮受体的药物是
A. 甘露醇
B. 氢氯噻嗪
C. 呋塞米
D. 阿米洛利
E. 螺内酯

正确答案：E。螺内酯

解析：本题考查螺内酯。竞争性结合醛固酮受体的药物是螺内酯（E对）。螺内酯为醛固酮的竞争性拮抗剂，可竞争性地与胞浆中的醛固酮受体结合而拮抗醛固酮的保钠排钾作用，促进Na⁺和水的排出，减少K⁺的排出。甘露醇（A错）为渗透性利尿药。氢氯噻嗪（B错）为噻嗪类利尿药。呋塞米（C错）为袢利尿剂。阿米洛利（D错）为肾小管上皮细胞Na⁺通道抑制剂。